关于城市道路规划，错误的是
A. 地面交通线路宜合理避让城市的噪声敏感建筑物区域
B. 南方城市的道路走向和夏季主导风向平行有利于城市通风
C. 城市道路要平坦，道路的最大纵坡一般不超过0.3%～0.5%
D. 车行道和人行道在夜间应有足够照度
E. 敷设主干管线的道路不能作为防灾救灾的主要通道

正确答案：C。城市道路要平坦，道路的最大纵坡一般不超过0.3%～0.5%

解析：本题考查城市道路规划。城市道路系统规划一方面要考虑交通方便、安全、快速的要求，也应考虑城市安全、城市环境及美化城市景观等方面的要求。规划城市道路网时，地面交通线路宜合理避让城市的噪声敏感建筑物区域（A对），以保证居住区的安全和安静。城市道路的走向应有利于城市通风和临街建筑物获得良好的日照。应按照当地气象部门提供的气象资料，科学合理地确定城市骨干道路的走向。南方城市的道路和夏季主导风向平行有利于城市通风（B对），北方城市道路和冬季主导风向成一定的角度可以有效抵御冬季寒风的侵袭。为了地面排水和地下管道埋设的需要，城市道路要有适宜的纵坡，道路的最小纵坡一般不小于0.3%～0.5%，考虑到自行车的爬行能力，最大纵坡一般不宜超过3%（C错，为本题正确答案）。为保证夜间交通和行人行走安全，车行道和人行道在夜间应有足够照度（D对）。敷设主干管线的道路不能作为防灾救灾的主要通道（E对），以防在开掘路面进行管线施工或维修时严重影响救灾交通运输。